血在脉中循行而不溢出脉外主要依靠气的
A. 推动作用
B. 固摄作用
C. 防御作用
D. 温煦作用
E. 气化作用

正确答案：B。固摄作用

解析：气防止精、血、津液等液态物质无故滑脱流失的作用称为气的固摄作用，体现于固摄血液，防止其逸出脉外，维持其正常循行（B对）。气化主要是指由人体之气的运动而引起的精气血津液等物质与能量的新陈代谢过程（E错）。气的防御作用是指气能护卫肌表，防御外邪入侵，同时也可以祛除侵入人体内的病邪（C错）。气的推动作用是指气中属阳部分（阳气）的激发、兴奋、促进等作用（A错）。气的温煦作用，指气中属阳部分（阳气）的促进产热，消除寒冷，使人体温暧的作用（D错）。